男性，成年人，46、36、37颊侧龈肿，肿胀突出、半球样，龈充血、表面光亮，自觉搏动痛，扪软而有波动，指压龈向内溢脓，牙松动明显，袋超过5mm，无龋，最可能的诊断是
A. 龈乳头炎
B. 急性多发性龈脓肿
C. 侵袭性牙周炎
D. 牙周脓肿
E. 慢性牙周炎

正确答案：D。牙周脓肿

解析：结合题干此病例表现符合牙周脓肿的表现，因有明显牙齿松动，可排除急性多发性龈脓肿，并可排除龈乳头炎，因此最可能的就是牙周脓肿。掌握“牙周脓肿”知识点。